女，18岁，未婚。月经规律，无停经史。突发下腹部疼痛伴恶心、呕吐8小时。查体：P78次/分，BP100/70mmHg，直肠腹部指诊：子宫前位，正常大小，右侧附件区触及一个6cm×5cm×5cm囊实性包块，边界清楚，触痛明显。最可能的诊断是
A. 卵巢黄体破裂
B. 输卵管妊娠破裂
C. 急性阑尾炎
D. 卵巢肿瘤蒂扭转
E. 浆膜下子宫肌瘤

正确答案：D。卵巢肿瘤蒂扭转

解析：青年女患者，未婚，月经规律，无停经史，突发下腹部疼痛伴恶心、呕吐，查体：P78次/分（正常值为60～100次/分），BP100/70mmHg（正常值为90～140/60～90mm/Hg），直肠腹部指诊：子宫前位，正常大小，右侧附件区触及一个6cm×5cm×5cm囊实性包块，边界清楚，触痛明显，根据患者临床症状及体征，考虑最可能的诊断为卵巢肿瘤蒂扭转（D对），卵巢黄体破裂（A错）除腹痛、恶心、呕吐外，还存在阴道少量出血，肛门下坠感，严重时还会出现出血性休克的临床表现。输卵管妊娠破裂（B错）者有停经史，该患者不存在停经史。急性阑尾炎（C错）主要表现为转移性右下腹痛，除了恶心、呕吐还伴有发热的症状，且麦氏点有压痛、反跳痛。浆膜下子宫肌瘤（E错）多无明显症状，多于体检时发现，临床主要表现为经量增多，经期延长。